胎心率变异减速的特征不包括哪项
A. 发生与宫缩无固定关系
B. 胎心率下降迅速
C. 胎心率恢复缓慢
D. 持续时间长短不一
E. 胎心率恢复迅速

正确答案：C。胎心率恢复缓慢

解析：胎心率变异减速的特点有：①胎心率减速发生与宫缩无固定关系（A对）②胎心率下降迅速（B对）且下降幅度大（＞15bpm）③持续时间长短不一（D对）④胎心率恢复迅速（E对）而不是胎心率恢复缓慢（C错，为本题正确答案）。